在临床上药物可以配伍使用或联合使用，若使用不当，可能出现配伍禁忌，下列药物配伍或联合使用中，不合理的是
A. 磺胺甲噁唑与甲氧苄啶联合应用
B. 地西泮注射液与0.9%氯化钠注射液混合滴注
C. 硫酸亚铁片与维生素C片同时服用
D. 阿莫西林与克拉维酸联合应用
E. 氨苄西林溶于5%葡萄糖注射液后在4小时内滴注

正确答案：B。地西泮注射液与0.9%氯化钠注射液混合滴注

解析：本题考查药物的配伍变化。地西泮注射液与0.9%氯化钠注射液混合滴注（B错，为本题正确答案）易析出沉淀，不宜配伍使用。磺胺甲噁唑与甲氧苄啶联合应用（A对）可使细菌的叶酸合成代谢遭到双重阻断，有协同作用，使磺胺药抗菌活性增强，并可使抑菌作用转为杀菌作用，减少耐药菌株。硫酸亚铁片与维生素C片同时服用（C对）的原理是一般是维生素C具有抗氧化作用,能将难吸收的三价铁转化为二价铁,促使铁剂被吸收、利用。阿莫西林与克拉维酸联合应用（D对）可抑制β-内酰胺酶活性，抵抗耐药性的产生。氨苄西林溶于5%葡萄糖注射液后应在4小时内滴注（E对）。